焦油、沥青致皮肤、黏膜外伤时，外涂
A. 氧化镁:甘油（1:2）糊剂
B. 羊毛脂
C. 5%～10%硼酸软膏
D. 5%硫代硫酸钠软膏
E. 5%～10%鞣酸软膏

正确答案：B。羊毛脂